慢性根尖周肉芽肿可以来源于不同种类的上皮，则以上哪种不属于其中的上皮成分
A. Malassez上皮剩余
B. 牙周袋壁上皮
C. Serres上皮剩余
D. 呼吸道上皮
E. 经瘘道口长入的口腔黏膜的上皮

正确答案：C。Serres上皮剩余

解析：本题考查急慢性根尖周炎。Serres上皮剩余（C错，为本题正确答案）不属于慢性根尖周肉芽肿可以来源的上皮成分。根尖周肉芽肿内的另一个重要特征是有上皮存在，其上皮来自：①牙周膜的Malassez上皮剩余（A对）；②口腔或皮肤上皮（E对）；③牙周袋上皮（B对）；④呼吸道上皮（D对）。